关于描述性研究，叙述不正确的是
A. 描述疾病和健康状态的分布
B. 为病因研究提供线索
C. 提出病因假设
D. 检验或验证假设
E. 是分析性研究的基础

正确答案：D。检验或验证假设

解析：本题考查描述性研究。描述性研究主要用来描述人群中疾病或健康状况及暴露因素的分布情况（A对），目的是提出病因假设（C对），为进一步调查研究提供线索（B对），该类研究还可用来确定高危人群，评价公共卫生措施的效果等，是分析性研究的基础（E对）。分析性研究主要是检验或验证假设（D错，为本题正确答案）。